青霉素的抗菌谱为
A. 敏感的革兰阳性和阴性球菌
B. 革兰阳性杆菌
C. 螺旋体
D. 支原体、立克次体
E. 革兰阴性杆菌

正确答案：A、B、C。敏感的革兰阳性和阴性球菌；革兰阳性杆菌；螺旋体

解析：本题考查青霉素的抗菌谱。青霉素属于天然的青霉素类抗生素，抗菌作用强，可用于：大多数G⁺球菌、G⁺杆菌（B对）、G⁻球菌（A对）、少数G⁻杆菌如流感杆菌、螺旋体（C对）、放线杆菌等。对大多数G⁻杆菌（E错）支原体作用较弱。对真菌、原虫、立克次体（D错）、病毒无作用。